男，72岁。排尿困难5年，夜尿4～5次。直肠指检可触及前列腺增生Ⅲ°。B超可查残余尿220ml，双肾中度积水，血Cr360μmol/L，尿常规：白细胞20～30个/HP，此患者目前选择哪项治疗方法最佳
A. 经耻骨后前列腺切除术
B. 膀胱造瘘术
C. 留置导尿
D. 药物治疗
E. 经膀胱前列腺切除术

正确答案：C。留置导尿